对感染性腹泻传染源的管理措施
A. 到2025年腹泻导致的死亡率降到1‰以下
B. 前六个月纯母乳喂养婴儿
C. “三管一灭”
D. 设立腹泻病门诊
E. 轮状病毒疫苗接种

正确答案：D。设立腹泻病门诊

解析：本题考查对感染性腹泻传染源的管理措施。对感染性腹泻传染源的管理措施有：1.建立防治门诊：各级医院和乡卫生院都应在感染性腹泻流行季节（或常年）设立腹泻病门诊（D对ABCE错）；2.开展疫情监测：包括人群监测和环境监测；3.建立健全疾病监测系统和报告制度：对传染源的措施要求做到“五早一就”，即早发现、早诊断、早报告、早隔离、早治疗和就地卫生处理。